依照《处方药与非处方药流通管理暂行规定》，执业药师应当向患者提供选购指导的药品是
A. 乙类非处方药
B. 甲类非处方药
C. 处方药、非处方药
D. 非处方药
E. 处方药

正确答案：D。非处方药

解析：本题考查药店零售管理。依照《处方药与非处方药流通管理暂行规定》，执业药师应当向患者提供选购指导的药品是非处方药（D对）。《处方药与非处方药流通管理暂行规定》第三章药店零售第十二条：甲类非处方药（B错）、乙类非处方药（A错）可不凭医师处方销售、购买和使用，但病患者可以要求在执业药师或药师的指导下进行购买和使用。执业药师或药师应对病患者选购非处方药提供用药指导或提出寻求医师治疗的建议。